男，40岁。腹胀、腹部持续性隐痛、发热一周。“肝炎”史12年，近4年来乏力纳差，面色晦暗，间断性齿龈出血。查体：腹部膨隆，无肌紧张，全腹压痛及反跳痛，肝未触及，脾肋下3cm，移动性浊音阳性。最可能的诊断是
A. 腹腔转移癌
B. 肝硬化合并自发性腹膜炎
C. 肝硬化合并肝肾综合征
D. 布-加综合征
E. 继发性腹膜炎

正确答案：B。肝硬化合并自发性腹膜炎

解析：该患者“肝炎”病史12年，近4年有乏力纳差、面色晦暗、间断性齿龈出血等肝功能减退表现，可初步诊断为肝炎后肝硬化。近一周出现腹胀、腹部持续性隐痛及发热（符合自发性腹膜炎的表现）。查体：全腹压痛及反跳痛等腹膜刺激征表现，移动性浊音阳性（腹水）。综合该患者病史、临床表现及体格检查，考虑诊断为肝硬化合并自发性腹膜炎（B对）。腹腔转移癌（A错）应具有原发癌的基本表现，如进行性消瘦、发热、食欲不振、乏力、营养不良和恶病质等肝区疼痛，肝大等。肝硬化合并肝肾综合征（P409）（C错）临床主要表现为少尿、无尿及氮质血症。布-加综合征（D错）是由于各种原因所致的肝静脉和邻近的下腔静脉狭窄闭塞，肝静脉和下腔静脉血液回流障碍，临床表现为肝大及疼痛、腹水，肝脏功能障碍等。继发性腹膜炎（E错）腹腔内有原发病灶，如空腔脏器穿孔、损伤或急性胆囊炎、阑尾炎含有细菌的渗出液在腹腔内扩散等引起腹膜急性化脓性炎症。